下列各项中不属医患之间非技术关系的是
A. 道德关系
B. 心理关系
C. 价值关系
D. 经济关系
E. 法律关系

正确答案：B。心理关系

解析：不属医患之间非技术关系的是心理关系，非技术关系是道德关系、价值关系、经济关系、法律关系、文化关系（B错，为本题正确答案）。